人体各部位中，以（）对电离辐射的反应最强
A. 腹部
B. 盆腔
C. 头颈部
D. 胸部

正确答案：A。腹部

解析：本题考查人体对电离辐射的反应。电离辐射会受到照射部位的影响。照射的几何条件不同，使机体各部位接受不均匀而影响吸收剂量。以腹部（A对BCD错）照射的反应最强，其次为盆腔、头颈、胸部和四肢。